疖和痈属
A. 蜂窝织炎
B. 脓肿
C. 卡他性炎
D. 纤维素性炎
E. 积脓

正确答案：B。脓肿

解析：疖是毛囊、皮脂腺及其周围组织的脓肿，痈是多个疖的融合，故两者都属于脓肿（B对）。蜂窝织炎（A错）和积脓（E错）均属于化脓性炎（P75），以中性粒细胞渗出，并伴有不同程度的组织坏死和脓液为特征。卡他性炎（P75）（C错）是指发生于黏膜的浆液性炎。纤维素性炎（P75）（D错）是以渗出物中含有大量纤维素为特征的炎症。